下列有关釉质发育不全的防治的说法中，不正确的是
A. 轻症患牙不必治疗
B. 患牙补充维生素D和矿物质
C. 由于患牙发育矿化较差，容易磨耗
D. 注意妇幼保健，可预防本病发生
E. 重症患牙用复合树脂或用口腔修复学的方法覆盖牙面

正确答案：B。患牙补充维生素D和矿物质

解析：对这类患牙再补充维生素D和矿物质，是毫无意义的。①注意妇幼保健，可预防本病发生。②由于患牙发育矿化较差，容易磨耗。患龋后发展较快，应进行防龋处理。③轻症患牙不必治疗；重症患牙用复合树脂或用口腔修复学的方法覆盖牙面，不仅可改善外观，而且有助于防止龋病的发生。掌握“釉质发育不全”知识点。